在（牙合）堤唇面画唇高线，唇低线是为了
A. 选择上下前牙的长度作参考
B. 选择上下前牙的宽度作参考
C. 确定上唇丰满度作参考
D. 确定牙合平面作参考
E. 确定上下前牙前后位置作参考

正确答案：A。选择上下前牙的长度作参考

解析：本题考查在（牙合）堤唇面画标志线-唇高线和唇低线。唇高线是微笑时上唇下缘的位置，唇低线是微笑时下唇上缘的位置，排牙时上前牙切缘在唇下露出2mm，所以画唇高线，唇低线是为了选择上下前牙的长度作参考（A对）。两侧口角之间的宽度是6个前牙的牙冠宽度，口角线是上下唇轻轻闭拢时，画出的口角在（牙合）托上的位置，是为了确定上下前牙的宽度度作参考（B错）。确定上唇丰满度（C错）参考面部组织形态、侧貌。确定（牙合）平面（D错）位置参考磨牙后垫高度的1/2。画标志线与确定上下前牙前后位置无关（E错）。